LOAEL指的是
A. 未观察到有害作用水平
B. 观察到有害作用的最低水平
C. 观察到作用的最低水平
D. 阈值

正确答案：B。观察到有害作用的最低水平

解析：本题考查LOAEL。LOAEL即观察到有害作用的最低水平（B对ACD错），是指在规定的暴露条件下，化学物引起机体（人或实验动物）某种有害作用的、已被观测到的最低剂量或浓度。